女，55岁，反复咳嗽、咳痰、气促30年，加重伴低热1周。既往高血压病史10年，血压控制满意。查体：T38℃,P110次/分，R24次/分，BP160/90mmHg。口唇发绀，颈静脉怒张，双肺可闻及哮鸣音的湿啰音，心率110次/分，律齐，P₂＞A₂，剑突下可闻及3/6级收缩期杂音。腹膨隆，肝肋下4cm，压痛（+），肝颈静脉回流征阳性，双下肢水肿。该患者最可能的诊断是
A. 冠心病
B. 心肌病
C. 肺血栓栓塞
D. 肺心病
E. 风湿性心脏瓣膜病

正确答案：D。肺心病

解析：中年女性患者，既往慢阻肺病史，近期加重，既往有高血压病史，查体：T38℃（正常值为36℃～37℃，发热），P110次/分（正常值为60～100次/分），心率增快，律齐，P₂>A₂，R24次/分（正常值为12～20次/分，呼吸加快），BP160/90mmHg（正常值为90～140/60～90mmHg，血压增高），口唇发绀（提示缺氧），颈静脉怒张（提示右心衰），双肺可闻及哮鸣音的湿啰音（提示肺水肿），剑突下可闻及3/6级收缩期杂音，腹膨隆（疑腹水），肝肋下4cm（肝脏增大），压痛（+），肝颈静脉回流征阳性，双下肢水肿（典型右心竭表现），根据患者的病史、临床症状和体征，该患者最可能的诊断为肺心病（D对）。冠心病（A错）根据冠脉病变的部位、供血范围、血管阻塞程度等，可有不同的临床表现，稳定型心绞痛是最常见的临床类型为阵发性胸骨后压迫性疼痛或窒息疼痛，可放射至心前区与左上肢侧面等，休息或舌下含服硝酸甘油可明显缓解。心肌病（B错）是一组异质性的心肌疾病，由不同病因引起，多与遗传有关，临床主要表现为心肌肥厚、心脏扩大、心力衰竭、心律失常与猝死。肺血栓栓塞（C错）临床表现多种多样，常无特异性，轻症可无明显症状，重者可以发生休克，甚至危及生命，常见症状有胸痛、呼吸困难、咯血等，诊断的关键是提高意识，按照疑诊、确诊、求因三个步骤进行。风湿性心脏瓣膜病（E错）二尖瓣受累最常见，多有明确风湿热的病史，病程缓慢，晚期进展迅速，主要表现为呼吸困难、咯血、咳嗽等，可有典型的二尖瓣面容。